《素问·至真要大论》中“皆属于心”的原文是
A. 诸厥固泄
B. 诸痛痒疮
C. 诸风掉眩
D. 诸寒收引
E. 诸气膹郁

正确答案：B。诸痛痒疮

解析：诸痛痒疮，皆属于心（B对）。诸厥固泄，皆属于下（A错）。诸风掉眩，皆属于肝（C错）。诸寒收引，皆属于肾（D错）。诸气膹郁，皆属于肺（E错）。